非处方药的含义包括
A. 消费者可直接从商店购买
B. 具有法律属性
C. 需经医师指导使用
D. 治疗轻微病症的药品
E. 必须经国家批准和公布

正确答案：A、B、D、E。消费者可直接从商店购买；具有法律属性；治疗轻微病症的药品；必须经国家批准和公布